光固化封闭剂目前常用的可见光源波长为
A. 300～400nm
B. 430～490nm
C. 500～600nm
D. 690～700nm
E. 750～800nm

正确答案：B。430～490nm

解析：光固化封闭剂目前常用的光源为430～490nm的可见光。掌握“窝沟封闭术”知识点。